计划实施的过程评价中，需要从以下各方面评估目标人群满意度，除外
A. 干预活动费用
B. 干预活动内容
C. 干预活动形式
D. 干预活动组织
E. 人际关系

正确答案：A。干预活动费用